牙髓失活一般选用
A. 多聚甲醛失活剂
B. 金属砷失活剂
C. 亚砷酸失活剂
D. A或B
E. A、B、C都可

正确答案：D。A或B

解析：本题考查牙髓失活剂。失活法是用化学药物制剂封于牙髓创面，使牙髓组织坏死失去活力的方法。失活法用于去髓治疗麻醉效果不佳或对麻醉剂过敏的患者。使牙髓失活的药物称为失活剂，常用多聚甲醛失活剂（A对）或金属砷失活剂（B对）（AB均对，故D为本题的正确答案）。多聚甲醛作用缓和，一般封药时间为2周左右。金属砷作用也比较缓和，一般恒牙封药时间为5到7天，乳牙一般为2到4天。亚砷酸失活剂（C错）又称三氧化二砷，有剧毒，一般封药24小时就可使牙髓失去痛觉活性，若封药时间过长，则会使根尖组织坏死，根尖孔尚未形成的患牙、乳牙不宜使用亚砷酸。